同类定量资料下列指标，反映样本均数对总体均数代表性的是
A. 四分位数间距
B. 标准误
C. 变异系数
D. 百分位数
E. 中位数

正确答案：B。标准误